躯干、四肢痛温觉第二级神经元发出的纤维交叉处
A. 白质后连合
B. 白质前连合
C. 延髓腹侧
D. 脑桥腹侧
E. 灰质连合

正确答案：B。白质前连合

解析：躯干、四肢痛温觉第2级神经元胞体主要位于第Ⅰ、Ⅳ到Ⅶ层，它们发出纤维上升1-2个节段经白质前连合（B对）交叉到对侧的外侧索和前索内上行。